下列项不是月经先期肝郁血热证的主症
A. 月经提前8天
B. 经量或多或少
C. 经色淡、质稀
D. 心烦易怒
E. 口苦咽干

正确答案：C。经色淡、质稀

解析：肝郁化热，则热灼于血，故经色深红或紫红，质稠（C对）。肝郁化热，热扰冲任，经血妄行，故月经提前（A错）。肝郁疏泄失调，血海失司，故经量过多或少（B错）。肝郁化热，热扰神魂，心神不宁，魂不守舍，而见急躁易怒（D错）。肝郁化热夹胆气上溢，则口苦，热灼津液，则口渴（E错）。